“疳者甘也”的含义是指
A. 病证
B. 病位
C. 病情
D. 病因
E. 症状

正确答案：D。病因

解析：“疳者甘也”指出小儿恣食肥甘厚腻，损伤脾胃，形成疳证，为小儿疳证形成的病因（D对ABCE错）。